长期大量使用利福平可出现的症状不包括
A. 黄疸
B. 肝脓肿
C. 肝肿大
D. 死亡
E. 肝功能减退等症状

正确答案：B。肝脓肿

解析：长期大量使用利福平可出现黄疸、肝肿大、肝功能减退等症状，严重时可致死亡。掌握“异烟肼、利福平及乙胺丁醇”知识点。